脑外伤昏迷在30分钟以内，轻度昏迷，得分为
A. 3分以下
B. 3～7分
C. 8～12分
D. 13～15分
E. 15分以上

正确答案：D。13～15分

解析：临床上常用格拉斯哥昏迷计分法（GCS）来判断颅脑损伤病人的病情，轻型患者GCS13～15分（D对），伤后昏迷时间＜20分钟；中型患者GCS9～12分，伤后昏迷20分钟～6小时；重型患者GCS3～8分，伤后昏迷＞6小时，或在伤后24小时内意识恶化并昏迷＞6小时。